血糖低于正常值，其临床意义可能是
A. 妊娠呕吐
B. 甲状腺功能减退
C. 情绪紧张
D. 腺垂体功能亢进
E. 嗜铬细胞瘤

正确答案：B。甲状腺功能减退

解析：本题考查空腹血糖的临床意义。血糖低于正常值，其临床意义可能是甲状腺功能减退（B对）。空腹血糖降低FBG<3.9mmol/L为血糖减低；FBG<2.8mmol/L为低血糖症。（1）生理性或暂时性低血糖：见于运动后、饥饿时，或妊娠、哺乳期等。（2）病理性低血糖：①胰岛素分泌过多：胰岛β细胞瘤；②降糖药过量：使用口服降糖药或胰岛素；③升高血糖激素分泌减少：甲状腺功能减退症、垂体功能减退等；④肝糖原储存不足：肝炎、肝坏死、肝癌等；⑤其他：特发性低血糖、服用水杨酸等药物。空腹血糖増高FBG≥7.0mmol/L为血糖增高；6.1mmol/L<FBG<7.0mmol/L为空腹血糖受损（IFG）。（1）生理性或暂时性高血糖：见于情绪紧张（C错）时或注射葡萄糖后等情况下。（2）病理性高血糖：①胰岛素分泌不足：1型糖尿病（分泌绝对不足）、2型糖尿病（分泌相对不足）；②升血糖激素分泌增加：见于甲状腺功能亢进症（D错）、嗜铬细胞瘤（E错）、肾上腺皮质功能亢进等；③应激状态：如脑卒中、颅脑损伤、心肌梗死、大面积烧伤等；④肝糖原代谢异常：如严重肝病、麻醉、窒息、癫痫等；⑤胰腺病变：如胰腺炎、胰腺癌等；⑥药物影响：如噻嗪类利尿剂、口服避孕药等；⑦脱水引起轻度高血糖，见于高热、呕吐（A错）、腹泻等。